尿素在肝的合成部位是
A. 胞质和微粒体
B. 胞质和线粒体
C. 线粒体和微粒体
D. 微粒体和高尔基体
E. 胞质和高尔基体

正确答案：B。胞质和线粒体